动物长期致癌试验中，对诱发肝癌敏感的动物是
A. 小鼠
B. 家兔
C. 豚鼠
D. 大鼠
E. 猫

正确答案：D。大鼠